根据《医疗机构制剂注册管理办法（试行）》，可以作为医疗机构制剂申报的品种是
A. 市场上已有供应，但价格昂贵的品种
B. 市场上没有供应的经典方剂
C. 中药、化学药组成的复方制剂
D. 市场上供应不足的生物制品
E. 市场上没有供应的中药注射剂

正确答案：B。市场上没有供应的经典方剂

解析：本题考察医疗机构制剂注册管理。市场上没有供应的经典方剂（B对）可以作为医疗机构制剂申报。